治疗军团病最有效的首选药物
A. 羟氨苄青霉素
B. 氯霉素
C. 头孢他啶
D. 克拉维酸
E. 红霉素

正确答案：E。红霉素

解析：本题考查红霉素。红霉素（E对）为大环内酯类，其通过抑制细菌蛋白质的合成而杀灭细菌，主要用于治疗青霉素过敏患者的替代用药、军团菌病、肺炎支原体肺炎等。羟氨苄青霉素（A错）用于对青霉素敏感的革兰阳性菌以及部分革兰阴性杆菌。氯霉素（B错）用于严重感染、脑膜炎及伤寒的治疗。头孢他啶（C错）对革兰阴性菌及厌氧菌均有较强的抗菌活性，用于严重感染。克拉维酸（D错）可保护不耐酶的抗菌药物结构免受破坏提高抗菌活性和效果，在临床抗感染治疗中发挥作用。